治肺热，咳嗽宜用
A. 通宣理肺丸
B. 养阴清肺丸
C. 蛇胆川贝液
D. 参贝北瓜膏
E. 苏子降气丸

正确答案：C。蛇胆川贝液

解析：本题考查的是蛇胆川贝液的主治。治肺热，咳嗽宜用蛇胆川贝液（C对）。蛇胆川贝液【主治】肺热咳嗽，痰多。通宣理肺丸（A错）【主治】风寒束表、肺气不宣所致的感冒咳嗽，症见发热、恶寒、咳嗽、鼻塞流涕、头痛、无汗、肢体酸痛。养阴清肺丸（B错）【主治】阴虚燥咳，咽喉干痛，干咳少痰，或痰中带血。参贝北瓜膏（D错）【主治】肺虚，咳嗽。苏子降气丸（E错）【主治】上盛下虚、气逆痰壅所致的咳嗽喘息、胸膈满闷。